属于聚山梨酯类非离子表面活性剂的是
A. 卵磷脂
B. 吐温80
C. 司盘80
D. 卖泽
E. 十二烷基硫酸钠

正确答案：B。吐温80

解析：本题考查表面活性剂。吐温80（B对）属于聚山梨酯类非离子表面活性剂；卵磷脂（A错）为两性离子型表面活性剂；司盘80（C错）为非离子型表面活性剂；卖泽（D错）为非离子型表面活性剂；十二烷基硫酸钠（E错）为阴离子型表面活性剂。